PaCO₂原发性降低见于
A. 代谢性酸中毒
B. 呼吸性酸中毒
C. 代谢性碱中毒
D. 呼吸性碱中毒
E. 酸碱平衡正常

正确答案：D。呼吸性碱中毒

解析：PaCO₂原发性降低见于呼吸性碱中毒，这是由于肺通气过度引起CO₂排出过多所导致。